与妊娠期高血压的发生关系最密切的是
A. 心、脾、肾功能失调
B. 肺、脾、肾功能失调
C. 肝、脾、肾功能失调
D. 肝、脾、肺功能失调
E. 心、肝、肾功能失调

正确答案：C。肝、脾、肾功能失调

解析：妊娠高血压中医病因病机主要责于素体脾肾两虚，因孕重虚，运化无权，水湿内停，发为子肿；肝气失调，阴虚阳亢，上扰清窍，可致头晕，即为妊娠高血压主要症状，所以与其发生关系最密切的是肝、脾、肾功能失调（C对）。